电镜下细胞内充满透明的分泌颗粒的细胞是
A. 浆液细胞
B. 黏液细胞
C. 闰管细胞
D. 分泌管细胞
E. 肌上皮细胞

正确答案：B。黏液细胞

解析：电镜下，黏液细胞细胞内充满透明的分泌颗粒，这些颗粒比浆液细胞颗粒大，聚集在细胞顶端，且形状不规则。掌握“唾液腺组织结构”知识点。